在体内作为脱羧酶辅酶的组成部分，参与维持正常的糖代谢及神经、心脏系统功能的维生素是
A. 维生素B₁
B. 维生素E
C. 维生素B₆
D. 维生素C
E. 叶酸

正确答案：A。维生素B₁

解析：本题考查维生素B₁。维生素B₁（A对）被人体吸收后，转变为硫胺焦磷酸酯，在体内作为脱羧酶辅酶的组成部分，参与维持正常的糖代谢及神经、心脏系统功能，临床主要用于维生素B₁缺乏症。维生素E（B错）临床可用于习惯性流产及不孕症的辅助治疗。维生素B₆（C错）临床适用于治疗恶心、呕吐，新生儿遗传性维生素B₆依赖综合征，预防贫血和智力减退。维生素C（D错）能够维持免疫功能，促进非血红素铁吸收所必需。叶酸（E错）临床用于治疗巨幼红细胞性贫血、血小板减少症。